适用于早期糖尿病肾病的降压药物是
A. 卡托普利
B. 普萘洛尔
C. 硝苯地平
D. 氢氯噻嗪
E. 哌唑嗪

正确答案：A。卡托普利

解析：卡托普利是血管紧张素转换酶抑制剂，可阻止AngⅡ的生成，从而取消AngⅡ的收缩血管、刺激醛固酮释放、升高血压等作用，可舒张出球小动脉，降低肾灌注压，且能减轻蛋白尿，可改善肾功能的恶化，具有肾脏保护作用，故卡托普利是适用于早期糖尿病肾病的降压药物（A对）。普萘洛尔（B错）、硝苯地平（C错）、氢氯噻嗪（D错）、哌唑嗪（E错）都是降压药，因其没有保护肾脏的作用，故都是不适用于早期糖尿病肾病的降压药物。